不属于减毒活疫苗的是
A. 卡介苗
B. 麻疹病毒
C. 风疹病毒
D. 脊髓灰质炎病毒
E. 破伤风类毒素

正确答案：E。破伤风类毒素

解析：目前应用的减毒活疫苗有卡介苗、麻疹病毒、脊髓灰质炎病毒、黄热病病毒、风疹病毒和腮腺炎病毒疫苗。破伤风类毒素属于类毒素疫苗。掌握“免疫预防及免疫治疗”知识点。